女，74岁。间断感觉环境晃动伴恶心2天。共发作5次，每次持续10～15分钟。有高血压病史。发作时查体：水平眼震阳性，左侧指鼻试验和跟膝胫试验阳性，闭目直立试验阳性。发作间隙期查体正常。双侧前庭功能试验正常。头颅CT无异常。可能的诊断是
A. 短暂性脑缺血发作
B. 小脑梗死
C. 脑桥梗死
D. 小脑出血
E. 中脑梗死

正确答案：A。短暂性脑缺血发作

解析：患者老年女性，间断眩晕发作2天，共发作5次，每次持续10-15分钟，有高血压病史，发作时查体：水平眼震阳性，左侧指鼻试验和跟膝胫试验阳性，闭目直立试验阳性（小脑性共济失调），发作间隙期查体正常，双侧前庭功能试验正常，头颅CT无异常。根据病史特点诊断为血流动力学障碍所致的椎-基底动脉系统短暂性脑缺血发作（A对）。短暂性脑缺血发作的典型特点为反复发作、每次发作症状类似，发病时可有神经系统损害症状和体征，持续时间短，临床一般不超过1小时，最长不超过24小时，且无责任病灶的证据，间歇期完全正常，椎-基底动脉系统短暂性脑缺血发作最常见的表现是眩晕、平衡障碍、眼球运动异常和复视。小脑梗死（B错）、脑桥梗死（C错）、小脑出血（D错）、中脑梗死（E错）均为脑实质性病变，临床症状和体征呈持续状态，无发作期和间歇期，CT有阳性表现。